现行《中小学校教室采光和照明卫生标准》规定，教室黑板面的平均照度不应低于
A. 100lx
B. 120lx
C. 150lx
D. 200lx
E. 500lx

正确答案：D。200lx